氧化苦参碱的结构特点包括
A. 有两个N原子
B. 有喹喏里西啶结构
C. 有一个叔胺N原子
D. 有一个酰胺N原子
E. 是苦参碱的N-氧化物

正确答案：A、B、C、D、E。有两个N原子；有喹喏里西啶结构；有一个叔胺N原子；有一个酰胺N原子；是苦参碱的N-氧化物

解析：本题考查的是氧化苦参碱的结构特点。氧化苦参碱的结构特点包括有两个N原子（A对）、有喹喏里西啶结构（B对）、有一个叔胺N原子（C对）有一个酰胺N原子（D对）与是苦参碱的N-氧化物（E对）。苦参所含主要生物碱是苦参碱和氧化苦参碱，《中国药典》以其为指标成分进行鉴别和含量测定，含量测定要求苦参碱和氧化苦参碱总量不得少于1.2%。此外苦参碱还含有羟基苦参碱、N-甲基金雀花碱、安那吉碱、巴普叶碱和去氢苦参碱（苦参烯碱）等。这些生物碱都属于双稠哌啶类，具喹喏里西啶的基本结构，除N-甲基金雀花碱外，均由两个哌啶环共用一个氮原子稠合而成。分子中均有两个氮原子，一个是叔胺氮，一个是酰胺氮。其中氧化苦参碱是苦参碱的N-氧化物，具半极性配位键，亲水性比苦参碱更强，易溶于水，可溶于三氯甲烷，但难溶于乙醚。